理中丸证的病机是
A. 中阳不足，肝脾失调
B. 中阳不足，阴寒内盛
C. 中阳不足，气机不畅
D. 中阳不足，运化失权
E. 中阳不足，水寒阻遏

正确答案：B。中阳不足，阴寒内盛

解析：理中丸所致诸证皆由脾胃虚寒所致。中阳不足寒从中生。为治疗中焦脾胃虚寒的基础方（B对）。